男性，40岁。右侧下颌骨磨牙区及下颌角处出现无痛性、逐渐膨大的肿块7年，生长缓慢。扪之有乒乓球感，无明显触痛。口内检查见右侧磨牙发生移位。X线片示：多房性囊性阴影，边缘不整齐呈半月形切迹状，无明显钙化灶影像。拟诊为成釉细胞瘤，根据临床诊断为防止复发手术切除至少应在肿瘤周围正常骨质的
A. 0．5cm处
B. 1cm处
C. 1．5cm处
D. 2cm处
E. 紧贴肿瘤包膜

正确答案：A。0．5cm处

解析：本题考查成釉细胞瘤的治疗。拟诊为成釉细胞瘤，根据临床诊断为防止复发手术切除至少应在肿瘤周围正常骨质的0.5cm处（A对）。成釉细胞瘤有局部浸润周围骨质的特点，治疗不彻底将导致复发，多次复发后可能恶变。故手术治疗时不应施行刮除术，须将肿瘤周围的骨质至少在0.5cm处切除。